男，34岁，主诉：近1～2年来自觉全口牙齿松动，咀嚼力量减弱。若此患者诊断为快速进展型牙周炎，造成此患者牙齿松动的最主要原因是
A. 牙龈炎症
B. 牙槽骨的吸收
C. 原发性（牙合）创伤
D. 继发性（牙合）创伤
E. 牙周韧带炎症

正确答案：B。牙槽骨的吸收

解析：本题考查快速进展型牙周炎牙松动的主要原因。牙槽嵴的吸收使牙周支持组织减少，是牙松动最主要的原因。快速进展型牙周炎患者牙槽骨呈中重度吸收（B对），是导致牙齿松动最主要的原因。牙龈炎症（A错）没有牙槽骨的吸收，不会导致牙齿的松动。原发性（牙合）创伤（C错）是指异常的（牙合）力作用于健康的牙周组织导致的创伤，快速进展型牙周炎时，其牙周组织已经遭到了明显的破坏，故不会存在原发性（牙合）创伤。继发性（牙合）创伤（D错）是指（牙合）力作用于病变的牙周组织，超过了病变牙周组织所能耐受的程度，导致的（牙合）创伤，快速进展型牙周炎中牙周组织破坏严重，牙齿松动移位，会导致继发性（牙合）创伤，相应的继发性（牙合）创伤会加剧牙齿的松动移位，但是并不是造成牙齿松动的主要原因。牙周韧带炎症（E错）可以导致牙明显松动，这是由于牙周膜充血水肿及渗出所致，快速进展型牙周炎不一定存在牙周韧带的炎症，因此牙周韧带炎症不是快速进展型牙周炎牙松动的主要原因。